饮食不节，脘腹痞胀，嗳腐吞酸，恶食呕吐，大便泄泻，舌苔厚腻，脉滑者治宜选用
A. 保和丸
B. 健脾丸
C. 半夏泻心汤
D. 枳实导滞丸
E. 三子养亲汤

正确答案：A。保和丸

解析：保和丸方含神曲、山楂、莱菔子、茯苓、半夏、陈皮、连翘，以消食化滞，理气和胃，主治食积证。脘腹痞满胀痛，嗳腐吞酸，恶食呕逆，或大便泄泻，舌苔厚腻，脉滑（A对）。健脾丸功用为健脾和胃，消食止泻，主治脾虚食积证（B错）。半夏泻心汤功用为寒热平调，消痞散结，主治寒热错杂之痞证（C错）。枳实导滞丸功用为消食导滞，清热祛湿，主治湿热食积证（D错）。三子养亲汤功用为温肺化痰，降气消食，主治痰壅气逆食滞证（E错）。